抗滴虫的特效药物是
A. 诺氟沙星
B. 磺胺米隆甲磺灭脓
C. 磺胺嘧啶
D. 甲硝唑
E. 甲氧苄啶

正确答案：D。甲硝唑

解析：咪唑类衍生物早期为抗滴虫和阿米巴原虫药，后被发现具有良好的抗厌氧菌作用。临床常用药有甲硝唑和替硝唑等。甲硝唑又称灭滴灵，是目前临床治疗各种厌氧菌感染的重要药物之一。对阿米巴滋养体有直接的杀灭作用，是治疗急慢性阿米巴痢疾、阿米巴肝脓肿的首选药。在阴道分泌物、精液、尿液中浓度较高，对阴道毛滴虫有强大的直接杀灭作用，可用于女性和男性泌尿生殖道滴虫感染。是目前最有效的抗贾地鞭毛虫药，用于贾地鞭毛虫引起的感染（D对）。